男性，31岁。1年来疑被人迫害、数次出走后被家人找回。近半年来常行为诡秘，将家中闹钟、收音机等在半夜深埋在公园树林地下，对亲友冷淡，生活懒散，房间内藏有刀棍等，体格检查无阳性发现。精神状况检查：接触被动，有自语自笑，衣着尚得体。其称“有人要谋害我”“有人命令我要么自杀、要么逃出去。”否认有病，无知力。症状学诊断为
A. 联想障碍
B. 幻觉妄想
C. 情感障碍
D. 意志活动减退
E. 人格解体

正确答案：B。幻觉妄想